进入空气中毒物浓度很高的生产场所时应使用
A. 防毒口罩
B. 防护服
C. 隔离式防毒面具
D. 过滤式防毒面具
E. 涂防护油膏

正确答案：C。隔离式防毒面具

解析：隔离式防毒面具（C对）吸入的空气并非经净化的现场空气，而是另行供给，适用于空气中毒物浓度很高的环境中使用。防毒口罩（A错）、防护服（B错）一般仅能满足普通危害防护，在空气中毒物浓度很高的生产场所防护作用很小。过滤式防毒面具（D错）适用于空气中有害物质浓度不高，且空气中含氧量不低于18%的场所。防护油膏仅能针对皮肤可吸收的有毒物质，空气中毒物主要通过呼吸道进入人体，涂防护油膏（E错）作用很小。